女，34岁。全程肉眼血尿1天，无血丝，血块，无尿频、尿急、尿痛，无发热及腰腹疼痛，尿沉渣镜检RBC满视野，WBC4～5/HP，尿蛋白（++）。首先应进行的检查是
A. 膀胱镜检查
B. 清洁中段尿培养
C. 静脉肾盂造影
D. 尿相差显微镜检查
E. 同位素肾动脉扫描

正确答案：D。尿相差显微镜检查

解析：患者年轻女性，全程肉眼血尿1天（提示病变部位为膀胱和上尿路），无血丝，血块，无尿频、尿急、尿痛（提示无膀胱刺激征），无发热及腰腹疼痛（提示无上尿路感染），尿沉渣镜检RBC满视野，WBC4～5/HP，尿蛋白（++）。患者全程肉眼血尿，提示病变部位为膀胱和上尿路，但无其他明显膀胱及上尿路症状，应先判断血尿来源，首选尿相差显微镜检查（D对）。膀胱镜检查（A错）主要是易患膀胱癌年龄范围（50至70岁）血尿病人的重要检查手段。清洁中段尿培养（B错）主要用于尿路感染诊断，该患者无尿路感染症状。静脉肾盂造影（C错）主要用于慢性尿路感染反复发作。同位素肾动脉扫描（E错）主要用于检查分侧肾功能。